女，75岁。胸痛5小时。心电图示V₁-V₅导联ST段抬高0.5mV。对明确诊断最有价值的实验室检查指标是
A. 血糖
B. 血脂分析
C. 肝肾功能
D. 血常规
E. 血肌钙蛋白

正确答案：E。血肌钙蛋白

解析：患者老年女性，胸痛5小时（心肌缺血、心肌梗死典型症状），心电图示V₁-V₅导联ST段抬高0.5mV（心梗典型心电图）。根据患者症状及心电图，考虑可能是急性心肌梗死。对明确心肌梗死诊断有帮助的是血肌钙蛋白（E对）。血糖（A错）为确诊糖尿病的诊断。血脂分析（B错）可以辅助分析冠状动脉栓塞、心绞痛、高血脂症。肝肾功能（C错）用于辅助分析药物毒性作用及肝肾疾病。血常规（D错）用于检查炎症及病毒感染。